属于胆汁酸合成限速酶催化的反应是
A. 氧化反应
B. 还原反应
C. 水解反应
D. 葡萄糖醛酸结合反应
E. 7α-羟化酶催化反应

正确答案：E。7α-羟化酶催化反应